失血性休克的治疗方法之中，首先需要补充的是
A. 全血
B. 血浆
C. 血小板
D. 平衡盐溶液
E. 葡萄糖

正确答案：D。平衡盐溶液

解析：本题考查休克。在失血性休克中，丧失的主要是血液，在补充血容量时，并不需要全部补充血液，首先应快速滴注等渗盐水或平衡盐溶液（D对）。